计算乙肝疫苗接种后血清检查阳转率，分母为
A. 乙肝感染人数
B. 乙肝疫苗接种后阳转人数
C. 乙肝患者人数
D. 该地平均人口数
E. 乙肝疫苗接种人数

正确答案：E。乙肝疫苗接种人数